医院药学工作的职业道德要求不包括
A. 合法采购，规范进药
B. 精益求精，确保质量
C. 精心调剂，热心服务
D. 维护患者利益，提高生活质量
E. 依法促销，诚信推广

正确答案：E。依法促销，诚信推广

解析：本题考查的是医院药学工作的道德要求。医院药学工作的职业道德要求不包括依法促销，诚信推广（E错，为本题正确答案）。医院药学工作的道德要求包括1.合法采购，规范管理（A对）。医院药品采购按照国家有关规定，实行主渠道定点选购和多渠道采购原则；计划采购原则；合理定量采购原则；质量为主、价格为辅的原则。2.精心调剂，耐心指导（C对）。在调配处方的过程中，相关道德规范包括：审方仔细认真，调配准确无误；调剂人员与审核人认真核对签字；发药时，要耐心向患者讲清服用方法与注意事项，语言通俗易懂，语气亲切。3.精益求精，确保质量（B对）。医院制剂必须坚持为临床服务的方向，坚持自用的原则；医院制剂也要执行GMP的有关规定。4.维护患者利益，提高生命质量（D对）。药品不良反应是危害人们身体健康的重要因素。医院药师要具有高度的社会道德责任感，从维护人类生命健康的角度，主动地报告药品不良反应。在临床药学服务的过程中，始终以患者为本，维护患者的利益，真诚、主动、热情、全心全意地为患者服务。